移植排斥反应损伤机制中能激活CTL，NK杀伤移植物，使B细胞产生Ab，介导ADCC的细胞因子是
A. TNF-α
B. IFN-γ
C. IL-2
D. IL-4
E. IL-5

正确答案：C。IL-2

解析：防治移植排斥反应最有效的措施是给予免疫抑制药，如糖皮质激素、环孢素（CsA）、FK506、西罗莫司和环磷酰胺等，其中CsA是目前临床上最广泛应用的免疫抑制药，其作用机制是直接或间接抑制Th细胞IL-2等细胞因子，抑制活化的T细胞表达IL-2受体。掌握“移植免疫”知识点。